郁证总的治法是
A. 疏肝解郁
B. 化痰散结
C. 养心安神
D. 养血柔肝
E. 疏通气机

正确答案：E。疏通气机

解析：郁证始于肝失条达，疏泄失常，以气机郁滞不畅为先，故郁证总的治法为疏通气机（E对）。疏肝解郁为郁证之肝气郁结证的治法（A错）。化痰散结为郁证之痰气郁结证的治法（B错）。养心安神为郁证之心神失养证的治法（C错）。养血柔肝治肝阴亏虚证，而郁证无肝阴亏虚证（D错）。